下列中不属于免疫缺陷病共同特点的是
A. 好发恶性肿瘤
B. 反复感染
C. 常患心血管病
D. 多伴有自身免疫病
E. 多有遗传倾向性

正确答案：C。常患心血管病